患者男性，42岁，右上6残根需拔除，X线片显示其腭侧根与上颌窦底影像重叠，判断牙根是否位于上颌窦内的征象为
A. 根尖周是否密度减低
B. 牙周膜与骨硬板是否连续
C. 上颌窦底是否突入牙根之间
D. 上颌窦是否过大
E. 垂直角度是否过大

正确答案：B。牙周膜与骨硬板是否连续

解析：如果牙周膜及骨硬板连续，则说明牙根没有位于上颌窦内，相反如果牙周膜及骨硬板没有连续性，就说明是牙根位于上颌窦内。掌握“牙拔除术并发症”知识点。